女，35岁。药物流产后3天，高热伴右下腹痛1天。妇科检查：白带脓性，宫颈举痛，宫体大小如妊娠六周，右附件区有明显压痛。对该病人的正确处理是
A. 急诊剖腹探查
B. 妇科手术处理
C. 等待宫颈分泌物
D. 临床应用抗生素
E. 不做任何处理，待其自然好转

正确答案：D。临床应用抗生素

解析：患者为青年女性，行药物流产后出现高热、下腹痛（急性盆腔炎的高危因素包括药物流产，主要表现为下腹痛，病情严重者出现高热），妇检：白带脓性，宫颈举痛，宫体增大、右附件区有明显压痛（盆腔检查：阴道可见脓性分泌物，宫颈充血、水肿，附件区压痛），最可能的诊断是急性盆腔炎。其治疗措施主要为抗生素治疗（D对），当出现抗生素控制不满意时的盆腔脓肿时，采用手术治疗如急诊剖腹探查（A错）、妇科手术处理（B错）。待宫颈分泌物明确前，可经验性地应用广谱抗生素以及联合用药（C错），及时有效缓解病情。